复方地芬诺酯包括地芬诺酯、阿托品，其机制是
A. 激动阿片受体、激动M胆碱受体
B. 拮抗阿片受体、拮抗M胆碱受体
C. 拮抗阿片受体、激动M胆碱受体
D. 激动阿片受体、拮抗M胆碱受体
E. 共同拮抗M胆碱受体

正确答案：D。激动阿片受体、拮抗M胆碱受体

解析：本题考查复方地芬诺酯。复方地芬诺酯含地芬诺酯和阿托品，地芬诺酯是哌替啶的衍生物，直接作用于肠平滑肌，激动阿片受体，消除局部黏膜的蠕动反射而减弱蠕动；阿托品拮抗M胆碱受体（D对），两者产生协同作用，加强对肠管蠕动的抑制作用。